处方书写白故纸，应付
A. 木蝴蝶
B. 番泻叶
C. 破故纸
D. 生补骨脂
E. 制补骨脂

正确答案：A。木蝴蝶

解析：本题考查的是常见的饮片正名与相关别名。处方书写白故纸，应付木蝴蝶（A对）。正名：木蝴蝶，别名：玉蝴蝶，千张纸，云故纸，白故纸。正名：补骨脂，别名：破故纸（C错）。